45岁以下患者，慢粒白血病慢性期缓解后
A. 骨髓移植
B. Ara‐C
C. 白细胞单采
D. 羟基脲
E. 干扰素

正确答案：A。骨髓移植

解析：骨髓移植应在CmL慢性期待血象及体征控制后尽早进行即缓解后，常规移植患者年龄＜45岁为宜，符合题意（A正确）。Ara-c一般急性淋巴细胞白血病缓解后或者复发和难治AmL的治疗药物，不合题意（B错）。白细胞单采用于治疗由于CmL或AL引起的高白细胞血症的紧急处理（C错）。羟基脲用于治疗CmL慢性期早期（D错）。干扰素同样用于慢性期早期（E错）。